下列哪一项可以分泌促性腺激素释放激素
A. 下丘脑
B. 胎盘
C. 卵巢髓质
D. 垂体后叶
E. 肾上腺髓质

正确答案：A。下丘脑

解析：月经周期的调节主要涉及下丘脑、垂体和卵巢。下丘脑分泌促性腺激素释放激素，调节垂体促性腺激素释放，调控卵巢功能。卵巢分泌性激素对下丘脑-垂体具有反馈调节作用。掌握“女性生殖系统生理”知识点。